锥形束CT显示患侧上颌窦密度弥漫性增高，周围可见肥厚黏膜影像，窦壁骨质无破坏的是
A. 牙源性中央性颌骨骨髓炎
B. 牙源性边缘性颌骨骨髓炎
C. 颌骨放射性骨坏死
D. 双磷酸盐相关颌骨坏死
E. 牙源性上颌窦炎

正确答案：E。牙源性上颌窦炎

解析：本题考查牙源性上颌窦炎。锥形束CT显示患侧上颌窦密度弥漫性增高，周围可见肥厚黏膜影像，窦壁骨质无破坏的是牙源性上颌窦炎（E对）。牙源性上颌窦炎锥形束CT及华特位片显示患侧上颌窦密度弥漫性增高或气腔明显缩小，周围可见肥厚的黏膜影像。窦壁骨质无破坏。